分泌激素调节碳水化合物代谢
A. 抗利尿激素
B. 生长激素
C. 垂体后叶
D. 胸腺
E. 肾上腺皮质

正确答案：E。肾上腺皮质

解析：调节碳水化合物代谢的激素是糖皮质激素，它是由肾上腺皮质（E对）分泌的。